邪入脏腑，病情严重者的指纹表现是
A. 透关射甲
B. 达于命关
C. 达于气关
D. 显于风关
E. 未超风关

正确答案：B。达于命关

解析：根据络脉在食指三关出现的部位，可以测定邪气的浅深、病情的轻重。指纹达于命关，是邪入脏腑，病情严重（B对）。透关射甲（A错）是指指纹直达指端，提示病情凶险，预后不良。指纹达于气关（C错），是邪气入经，邪深病重。指纹显于风关（D错），是邪气入络，邪浅病轻，可见于外感初起。未超风关（E错）为正常指纹特点。